最易发生阴阳互损的脏是
A. 心
B. 肝
C. 脾
D. 肺
E. 肾

正确答案：E。肾

解析：心主血脉和神明，多易发生血脉运行的障碍和情志思维活动的异常（A错）。肝为刚脏，体阴而用阳，以实证为多见（B错）。脾主运化，包过运化水谷和水湿，发生的疾病多有消化和湿有关（C错）。肺主气，司呼吸，易出现气机出入升降的失常（D错）。肾藏精，肾中精气是肾阴肾阳的根本，肾阴肾阳又是全是阴阳的根本，易出现肾阴虚、肾阳虚，互根互用关系失调出现阴阳互损（E对）。